健康教育的具体目标是
A. 为实现总目标所要达到的具体结果，确定在一定的时间内完成
B. 为实现总目标所要达到的具体结果，确定在一定的地点完成
C. 为实现总目标所要达到的具体结果，确定在某个家庭或人群完成
D. 为实现总目标所要达到的具体结果，有明确、具体、可测量的指标
E. 为实现总目标所要达到的具体结果，确定采用某种方法能够完成

正确答案：D。为实现总目标所要达到的具体结果，有明确、具体、可测量的指标